下列对成人识字率表述正确的是
A. 识字人口占总人口的百分比
B. 15岁以上识字人口占总人口的百分比
C. 15岁及以上识字人口占总人口的百分比
D. 18岁以上识字人口占总人口的百分比
E. 18岁及以上识字人口占总人口的百分比

正确答案：C。15岁及以上识字人口占总人口的百分比

解析：本题考查成人识字率。成人识字率指15岁及以上识字人口占总人口的百分比（C对ABDE错）。